哪项不是可摘局部义齿的组成
A. 固位体
B. 基牙
C. 人工牙
D. 基托
E. 连接体

正确答案：B。基牙

解析：可摘局部义齿一般是由人工牙、基托、固位体和连接体等部件组成。按照部件所起的作用，可以归纳为三部分，即修复缺损部分、固位稳定部分和连接传力部分，基牙不属于其部件。掌握“局部义齿人工牙及基托”知识点。